梅毒病原体检测不易见于
A. 血液
B. 精液
C. 乳汁
D. 汗液
E. 唾液

正确答案：D。汗液

解析：患者皮损、血液、精液、乳汁和唾液中均有螺旋体存在。掌握“梅毒的口腔表征”知识点。